自身免疫病是由于哪一项免疫功能损害所致
A. 免疫调节
B. 免疫监视
C. 免疫防御
D. 免疫自稳
E. 抗原提呈

正确答案：D。免疫自稳